在对瘿病肿块触诊时，除对其肿块位置、数目、硬度、光滑度、活动度、界限进行检查外，还应注意的是
A. 颈部活动是否受限
B. 颈部皮肤是否肿胀
C. 肿块有无震颤，气管是否移位，淋巴结是否肿大
D. 下颌活动是否正常
E. 颈静脉是否怒张

正确答案：C。肿块有无震颤，气管是否移位，淋巴结是否肿大

解析：对瘿病肿块触诊时，注意有无震颤，气管有无移位，颈部淋巴结是否肿大等有利于判断该肿块的良恶性（C对）。颈部活动受限常见于颈椎病及颈部的筋伤（A错）。瘿是甲状腺疾病的总称，是指颈前结喉两侧肿大的一类疾病，故颈部皮肤肿胀，为瘿病的共同特点，无需特别注意，且属望诊（B错）。瘿病一般不影响下颌活动（D错）。颈静脉怒张可见于血瘿与筋瘿，或肿大的甲状腺压迫深部静脉，引起颈部浅表静脉扩张，但属望诊内容（E错）。